属于牙膏中摩擦剂的是
A. 薄荷
B. 丙三醇
C. 苯甲酸盐
D. 二氧化硅
E. 月桂醇硫酸钠

正确答案：D。二氧化硅

解析：摩擦剂：通过刷牙时的机械作用，摩擦剂可以帮助清洁与磨光牙面，是牙面清洁、光滑、发亮，去除色素沉着、菌斑。理想的摩擦剂清洁能力强，对牙面无损伤，提供高度磨光，能够防止色素再沉着。约占牙膏含量的20%～60%。常用的摩擦剂有碳酸钙、焦磷酸钙、磷酸氢钙，氢氧化铝、二氧化硅，硅酸盐等。掌握“自我口腔保健方法”知识点。